腰痛辩证，应首先辨别
A. 阴阳的盛衰
B. 本虚与标实
C. 外感与内伤
D. 病邪的轻重
E. 部位与范围

正确答案：C。外感与内伤

解析：腰痛多由外感，内伤或跌仆闪挫，导致筋脉痹阻，腰府失养所致。所以腰痛的辨证首先要辨别外感与内伤（C对）。虚实兼见者，宜辨主次轻重，标本兼顾。若因感受外邪所致者，治以祛邪通络为主；若由肾虚内伤所致者，治以补肾壮腰为主；外伤所致者，治宜活血化瘀，通络止痛。